患者恶寒重，发热轻，无汗，头痛，肢体疼痛，鼻塞声重，时流清涕，喉痒，舌苔薄白而润，脉浮。其治法是
A. 散寒解肌
B. 辛温解表
C. 调和营卫
D. 散寒止痛
E. 发汗解肌

正确答案：B。辛温解表

解析：根据“鼻塞、流涕、喷嚏、头痛、恶寒、发热、全身不适”，可知病为“感冒”；根据“恶寒重，发热轻，无汗，舌苔薄白而润，脉浮”，可辨为“风寒束表证”，治疗应以辛温解表为法（B对）。“散寒解肌”为寒邪袭表的治法（A错）。“调和营卫”为营卫失和的治法（C错）。“散寒止痛”为寒邪客于脏腑经脉引起痛证的治法（D错）。“发汗解肌”为治疗发热汗出不畅的治法（E错）。